“颗粒型重度型宫颈糜烂”的正确处理是
A. 定期检查
B. 物理治疗
C. 先做宫颈刮片检查，排除早期宫颈癌后，再做治疗
D. 药物治疗
E. 宫颈锥切

正确答案：C。先做宫颈刮片检查，排除早期宫颈癌后，再做治疗

解析：颗粒型重度宫颈糜烂患者经确诊后，需进一步做衣原体及淋病奈瑟菌的监测，宫颈刮片或做TCT宫颈细胞学检查，排出早期宫颈癌病变，然后主要针对病原体治疗，治疗应及时彻底，以免转为慢性（C对）。定期检查（A错）主要是注意创面愈合情况及有股宫颈管狭窄，适用于慢性宫颈炎症及经治疗后的宫颈炎症。物理治疗（B错）虽适用于糜烂面积较大、炎症浸润较深的病例，但治疗前应常规做宫颈刮片细胞学检查。药物疗法（D错）适用于糜烂面较小或炎症浸润较浅的病例。宫颈锥切（E错）手术治疗适用于糜烂面较深、较广或累积宫颈管者，如需手术治疗的重度宫颈糜烂患者应首先借助三阶梯检查方法即宫颈细胞学检查、阴道镜检查、宫颈和宫颈管活组织检查，详细了解宫颈及盆腔情况后，方可选择制定手术治疗方案。